颈淋巴转移率最高，且早期转移的肿瘤是
A. 舌癌
B. 唇癌
C. 颊癌
D. 牙龈癌
E. 上颌窦癌

正确答案：A。舌癌

解析：舌癌常发生早期颈淋巴结转移，且转移率很高。因舌体组织具有丰富的淋巴和血液循环，舌体活动频繁等，均成为促使舌癌发生转移的因素。掌握“鳞状细胞癌概述及舌癌、牙龈癌”知识点。